患者，女性，26岁，症见右下肢暗红微肿，灼热疼痛，溃烂腐臭，发热，口渴，舌红脉数者。治宜选用
A. 透脓散
B. 普济消毒饮
C. 大黄牡丹汤
D. 四妙勇安汤
E. 仙方活命饮

正确答案：D。四妙勇安汤

解析：患者右下肢溃烂，微红肿痛，发热口渴，舌红脉数，符合脱疽湿热毒盛证表现，用四妙勇安汤加减（D对）。透脓散适用于疮疡中期内脓已成不易外溃者（A错）。普济消毒饮适用于疮疡风热毒上攻证（B错）。大黄牡丹汤适用于肠痈瘀滞证（C错）。仙方活命饮适用于痈疽疮疡初起（E错）。